男，44岁。乏力、低热、腹泻、伴体重下降3个月。近1年有吸毒史。查体：颌下及腋下淋巴结肿大。对明确诊断最有价值的检查是
A. 骨髓培养
B. 血清抗-HIV抗体
C. 粪便培养
D. 淋巴结活检
E. PPD试验

正确答案：B。血清抗-HIV抗体

解析：44岁男性患者，近1年有吸毒史（易感人群），乏力、低热、腹泻、伴体重下降3个月，查体颌下及腋下淋巴结肿大（HIV相关症状），根据患者的临床表现和查体，最可能的诊断是艾滋病，对明确诊断最有价值的是血清抗–HIV抗体（B对），是HIV感染诊断的金标准。骨髓培养（A错）多用于伤寒确诊。粪便培养（C错）多用于菌痢、霍乱诊断。淋巴结活检（D错）可用于感染（细菌、病毒、真菌、虫）、结核病及白血病、淋巴瘤、恶组、转移癌等疾病诊断。PPD试验（E错）用于结核诊断。